男，30岁。外伤性脾破裂脾切除术后3天。查体：BP106/68mmHg，中心静脉压18cmH₂O。此时应采取的治疗措施是
A. 利尿
B. 舒张血管
C. 收缩血管
D. 适当补液
E. 充分补液

正确答案：B。舒张血管

解析：青年男性患者，脾切除术后3天，血压正常，中心静脉压升高（正常值5～10cmH₂O），提示容量血管过度收缩，此时应采取的措施是舒张血管（B对C错）（P33）。利尿（A错）主要常用于因循环血量增加而出现血压升高的患者。适当补液（D错）用于因血容量不足而出现血压正常但中心静脉压降低的患者。充分补液（E错）用于因血容量严重不足而出现血压和中心静脉压都降低的患者。